县级以上人民政府卫生行政部门应当给予表彰或者奖励的情形
A. 医德高尚，事迹突出的
B. 对医学专业技术有重大突破
C. 长期在边远贫困地区基层单位努力工作的
D. 国务院卫生行政部门规定应当予以表彰或者奖励的其他情形的
E. 以上说法均正确

正确答案：E。以上说法均正确

解析：医师有下列情形之一的，县级以上人民政府卫生行政部门应当给予表彰或者奖励：①在执业活动中，医德高尚，事迹突出的；②对医学专业技术有重大突破，作出显著贡献的；③遇有自然灾害、传染病流行、突发重大伤亡事故及其他严重威胁人民生命健康的紧急情况时，救死扶伤、抢救诊疗表现突出的；④长期在边远贫困地区、少数民族地区条件艰苦的基层单位努力工作的；⑤国务院卫生行政部门规定应当予以表彰或者奖励的其他情形的。掌握“医师执业规则及培训、考核及法律责任”知识点。